女，65岁。诊断2型糖尿病1年，饮食运动控制，检测空腹血糖7.5mmol/L，餐后2h血糖11.4mmol/L.既往体健，查体身高160cm，体重70kg，心肺查体未见异常。其降血糖药首选
A. 格列本酮
B. 二甲双胍
C. 格列吡嗪
D. 胰岛素
E. 阿卡波糖

正确答案：B。二甲双胍

解析：该患者诊断2型糖尿病1年，根据患者身高体重可算得BMI【体重（Kg）/身高2（m）】为27.3，判断为超重，应首选二甲双胍类治疗，二甲双胍（B对）可以使HbA1c下降1% -2%， 但不增加体重。磺脲类（AC错）主要选择应用于新诊断的T2DM非肥胖病人。阿卡波糖（E错）主要适用于空腹血糖正常（或不太高）而餐后血糖明显升高者。胰岛素（D错）主要用于糖尿病病程中无明显诱因出现体重显著下降者。